植物性食物如剩米饭、奶油蛋糕、油煎食品等可引起哪种食物中毒
A. 沙门菌中毒
B. 副溶血性弧菌中毒
C. 葡萄球菌肠毒素中毒
D. 肉毒梭菌中毒
E. 变形杆菌中毒

正确答案：C。葡萄球菌肠毒素中毒